首次提出生物-心理-社会医学模式的科学家是
A. 培根
B. 希波克拉底
C. 恩格尔
D. 魏尔啸
E. 笛卡尔

正确答案：C。恩格尔

解析：本题考查首次提出生物-心理-社会医学模式的科学家。1977年，美国精神病学和内科学教授恩格尔（C对ABDE错）首次提出生物-心理-社会医学模式。